接触苯的氨基、硝基化合物引起溶血性贫血的作用机制中，不正确的是
A. 高铁血红蛋白形成
B. 还原型谷胱甘肽的减少
C. 氧化型谷胱甘肽的减少
D. 赫恩滋小体的形成
E. 先天性葡萄糖-6磷酸脱氢酶的缺陷

正确答案：C。氧化型谷胱甘肽的减少